毒物兴奋效应是
A. 低剂量时不表现刺激性，在高剂量下表现出强烈的刺激作用
B. 低剂量表现适当的刺激性，在高剂量下表现出强烈的刺激作用
C. 低剂量时表现出适当刺激性，在高剂量下表现为抑制作用
D. 低剂量时表现为抑制作用，在高剂量下表现为刺激作用

正确答案：C。低剂量时表现出适当刺激性，在高剂量下表现为抑制作用

解析：本题考查毒物兴奋效应。毒物兴奋效应是指在低剂量条件下表现为适当的刺激（兴奋）反应，而在较高或高剂量条件下表现为抑制作用（C对ABD错）。